医疗机构在从事医疗卫生技术工作中对非卫生技术人员
A. 可以使用
B. 尽量不用
C. 不得使用
D. 在次要的科室可以使用
E. 一些特殊科室可以使用

正确答案：C。不得使用

解析：医疗机构执业规则中对于非卫生技术人员的规定是不得使用此类人员从事医疗卫生技术工作。掌握“医疗机构概述及机构执业”知识点。